下列治则中，属正治法的是
A. 以热治热
B. 以寒治寒
C. 塞因塞用
D. 寒着热之
E. 通因通用

正确答案：D。寒着热之

解析：本题考查的是正治法的治则。下列治则中，属正治法的是寒者热之（D对）。正治，又称逆治，是指采用方药的性质与疾病的证候性质相反的治疗法则。逆，即采用方药的性质与疾病的性质相反。正治，适用于临床表现与疾病证候本质相一致的病证。临床上大多数疾病的临床表现与疾病的证候性质是相符的，如寒病即见寒象、热病即见热象、虚病即见虚象、实病即见实象等，所以，正治是临床上最常用的一种治疗法则。常用的治法有寒者热之、热者寒之、虚则补之、实则泻之等。反治，又称从治，是指顺从疾病证候的外在假象而治的治疗法则。反治，主要包括热因热用、寒因寒用、塞因塞用（C错）、通因通用（E错）四种治法。1.热因热用又称“以热治热（A错）”，是指针对假热的临床表现，用热性药物进行治疗。2.寒因寒用又称“以寒治寒（B错）”是指针对假寒的临床表现，用寒性药物进行治疗。